在单凝聚法制备微囊的过程中，起凝聚剂作用的物质是
A. 明胶
B. 10%醋酸
C. 60%硫酸钠溶液
D. 甲醛
E. 稀释液

正确答案：C。60%硫酸钠溶液

解析：本题考查单凝聚法制备微囊的原理。单凝聚法是指在囊心物和高分子囊材共同存在的溶液中参加凝聚剂以降低高分子材料的溶解度而凝聚成囊的方法。在单凝聚法制备微囊的过程中，起凝聚剂作用的物质是60%硫酸钠溶液（C对）。